暴露组的发病率与非暴露组发病率之差再除以暴露组的发病率
A. 率比（RR）
B. 优势比（OR）
C. 人时发病率
D. 归因危险度
E. 病因分值

正确答案：E。病因分值

解析：本题考查病因分值的概念。病因分值（E对ABCD错）又称为归因危险度百分比，是指暴露人群中的发病或死亡归因于暴露的部分占全部发病或死亡的百分比。